不用于肠外营养的是
A. 电解质
B. 脂肪乳
C. 氨基酸
D. 葡萄糖
E. 白蛋白

正确答案：E。白蛋白

解析：肠外营养由碳水化合物（D对）、脂肪乳剂（B对）、氨基酸（C对）、水、维生素、电解质（A对）及微量元素等基本营养素组成（E错，为本题正确答案）。